女性，44岁，反复发作上腹部疼痛3年，近3天上腹绞痛，伴发热寒颤，皮肤巩膜黄染。该病人首选检查方法是
A. B超
B. CT
C. MRI
D. PTC
E. ERCP

正确答案：A。B超

解析：中年女性，3天来腹痛、寒战高热、黄疸（Charcot三联征，继发胆管炎典型表现），根据临床表现及病史，应考虑胆管结石并胆管炎。B超（A对）可以发现结石，并明确其大小和部位，操作简单，价格低廉，对结石的诊断准确率接近100%，是病人首选检查方法。CT（B错）、MRI（C错）价格昂贵、操作繁琐，不宜作为首选检查。PTC（经皮肝穿刺单管造影）（D错）虽可显示肝内外胆管病变部位、范围、程度和性质等，但由于其是有创检查，胆管不扩张时，穿刺成功率较低，且容易导致一定的并发症，不适合胆结石的检查。ERCP（内镜逆行胰胆管造影）（E错）是纤维十二指肠镜直视下通过十二指肠乳头将导管插入胆管和（或）胰管内进行造影。可显示胆道系统和胰腺导管的解剖和病变，可行胆总管下端结石取石及胆道蛔虫病取虫等治疗，但患者有胆管炎，属于ERCP禁忌症，不可行ERCP检查。